下列哪条不是流行病学实验的目的
A. 检验和评价干预措施（含临床和预防）的效果
B. 评价治疗药物和方法对解除病痛，提高生存率的效果
C. 评价干预措施后对预防疾病发生的效果
D. 评价新疫苗对预防某种传染病发生的效果
E. 评价自动戒烟对降低某疾病发生和死亡的效果

正确答案：E。评价自动戒烟对降低某疾病发生和死亡的效果